患者女性，54岁，被鱼刺刺伤右手示指指尖两天，出现手指端针刺样疼痛、肿胀就诊，患指剧痛、肿胀明显。应及时采取的治疗方式为
A. 抗生素控制感染
B. 右手示指的理疗
C. 切开引流
D. 保持右手下垂，以利于血液循环
E. 冰敷

正确答案：C。切开引流

解析：患者右手示指尖刺伤史2天，出现手指端针刺样疼痛、肿胀，考虑右手示指脓性指头炎。指头炎初发时应悬吊前臂、平放患手（D错），避免下垂以减轻疼痛，给予敏感抗生素（A错），以金黄散糊剂敷贴患指。如患指剧痛、肿胀明显、伴有全身症状，应及时切开引流，以免发生指骨坏死及骨髓炎（C对）。